男，40岁，多饮多食2年，加重几个月，突然出现大汗，高热，昏迷，查体甲状腺肿大，以下治疗方法不正确的是
A. 抗甲状腺药物
B. 碘剂
C. 阿司匹林降温
D. 抗生素
E. 糖皮质激素

正确答案：C。阿司匹林降温

解析：该患者男，40岁，多饮多食2年，加重几个月，突然出现大汗，高热，昏迷，查体甲状腺肿大，结合患者的表现，考虑为甲状腺危象，在高热时，应给予物理降温，避免用乙酰水杨酸类药物，其余选项均正确（C错，为本题的正确答案）。